下列药物中，属于肝药酶抑制剂的是
A. 利福平
B. 苯妥英钠
C. 西咪替丁
D. 双香豆素
E. 苯巴比妥

正确答案：C。西咪替丁

解析：能使药物肝药酶活性降低、药物代谢减慢的药物叫做肝药酶抑制剂；能使肝药酶活性增高、药物代谢加快的药物叫做肝药酶诱导剂；属于肝药酶抑制剂的是西咪替丁，利福平（A错）、苯妥英钠（B错）、苯巴比妥（E错）均为肝药酶诱导剂，可加速自身及许多其他药物代谢。双香豆素（D错）为抗凝血药物，在肝脏代谢。